鼻腔外侧壁不包括
A. 上鼻甲
B. 蝶筛隐窝
C. 中鼻甲
D. 筛骨垂直板
E. 下鼻甲

正确答案：D。筛骨垂直板

解析：鼻腔外侧壁包括上、中、下三个鼻甲（ACE对），还有蝶筛隐窝（B对）。筛骨垂直板是鼻腔内侧壁的结构（D错，为本题正确答案）。